基台依据功能可以主要分为
A. 两种类型
B. 三种类型
C. 四种类型
D. 五种类型
E. 无此分类

正确答案：A。两种类型

解析：基台：指连接于植入体上方穿过牙龈的结构，通过基台下端的内连接或外连接抗旋转结构与植入体上端依靠中央螺丝固定连接，是可摘或固定修复体的附着结构。依据功能可以主要分为修复基台、愈合基台两种类型。基台的材质、被动适合性及连接的抗旋转结构十分重要。当植入体的长轴与修复体的牙冠长轴不在一条直线上时，可采用角度基台来改善基台方向。掌握“种植义齿的组成和修复治疗原则”知识点。